米非司酮的作用机制是
A. 抗受精卵着床
B. 引发足够的子宫活性
C. 对皮质醇水平影响
D. 促子宫内膜壁充血增厚
E. 促进子宫内膜脱落

正确答案：A。抗受精卵着床

解析：本题考查米非司酮的作用机制。米非司酮通过竞争孕激素受体，拮抗孕酮，具抗受精卵着床作用（A对）。米非司酮不能引发足够的子宫活性（B错），不能促子宫内膜壁充血增厚（D错）和促进子宫内膜脱落（E错）。在有效剂量下对皮质醇水平无明显影响（C错）。